女，38岁。接触性出血半年。妇科检查外阴阴道无异常，宫颈轻度糜烂，触之易出血。子宫正常大小，双侧附件未触及异常。如为宫颈上皮内瘤变Ⅲ级，宜采取的处理方法是
A. 子宫切除术
B. 放射治疗
C. 化学治疗
D. 宫颈锥形切除术
E. 随访观察

正确答案：D。宫颈锥形切除术

解析：患者为中年女性，接触性出血（宫颈癌常表现为接触性出血，即性生活或妇科检查后阴道流血），妇检：宫颈轻度糜烂，触之易出血。病理检查结果为宫颈上皮内瘤变Ⅲ级（CINⅢ），宜采取的处理方法是宫颈锥形切除术（D对）。全子宫切除术（P304）（A错）适用于经子宫颈锥切确诊、年龄较大、无生育要求、合并有其他手术指征的妇科良性疾病的CINⅢ患者。放射治疗（B错）、化学治疗（C错）适用于恶性肿瘤的治疗。随访观察（P303）（E错）适用于CINⅠ患者。